具有解表通便作用的方剂是
A. 麻黄杏仁甘草石膏汤
B. 葛根黄芩黄连汤
C. 防风通圣散
D. 大柴胡汤
E. 凉膈散

正确答案：C。防风通圣散

解析：本题考查方剂的功效主治之间的比较。防风通圣散为表里双解剂，主治风热壅盛，表里俱实证，功效疏风解表，泄热通便（C对）。麻黄杏仁甘草石膏汤只具有解表之功，不具有通便作用（A错）。葛根黄芩黄连汤由葛根、甘草、黄芩、黄连组成，本方功能解表清里，然而从药物配伍作用来看，显然是清里热为主，并不具通便作用（B错）。大柴胡汤为小柴胡汤与小承气汤两方加减变化而成，是和解为主与泻下并用的方剂，不具有解表作用（D错）。凉膈散功用泻火通便，清上泻下，不具解表之功，并且泻下是为清泻胸膈郁热而设，而不在于热结便秘（E错）。